炉甘石属于
A. 硫化物类矿物
B. 硫酸盐类矿物
C. 碳酸盐类矿物
D. 氧化物类矿物
E. 卤化物类矿物

正确答案：C。碳酸盐类矿物

解析：本题考查的是矿物类中药的分类。炉甘石属于碳酸盐类矿物（C对）。矿物类中药按阴离子分类法分类：朱砂、雄黄、自然铜等为硫化合物类（A错）；石膏、芒硝、白矾为硫酸盐类（B错）；炉甘石、鹅管石为碳酸盐类；磁石、赭石、信石为氧化物类（D错）；轻粉为卤化合物类（E错）。